布洛芬的含量测定方法为
A. 以中性乙醇为溶剂，酚酞作指示剂，用氢氧化钠滴定液滴定
B. 以中性乙醇为溶剂，甲基红作指示剂，用硫酸滴定液滴定
C. 以中性乙醇为溶剂，酚酞作指示剂，用氢氧化钠滴定液中和后，加入定量过量的氢氧化钠滴定液，在水浴上加热l5分钟，放冷，用硫酸滴定液回滴
D. 以磷酸盐缓冲液为溶剂，在222nm的波长处测定吸光度，按吸收系数（E1cm）为449计算
E. 以十八烷基硅烷键合硅胶为固定相，醋酸盐缓冲液-乙腈（40∶60）为流动相，检测波长为263nm，用外标法测定

正确答案：A。以中性乙醇为溶剂，酚酞作指示剂，用氢氧化钠滴定液滴定